口腔是消化管的起始部，向前经口裂通于外界，向后经咽峡通于咽，上界为腭，下界为口腔底，两侧壁为颊。关于口腔的叙述，正确的是
A. 腭构成口腔的上壁，前1／3为硬腭，后2／３为软腭
B. 向后经咽峡通食管
C. 借牙弓和牙龈将口腔分为口腔前庭和固有口腔
D. 上、下牙咬合时，固有口腔与口腔前庭完全不能相通
E. 为牙与唇、颊之间的空隙

正确答案：C。借牙弓和牙龈将口腔分为口腔前庭和固有口腔

解析：腭构成口腔上壁，前2/3为硬腭，后1/3为软腭(A错)，向后经咽峡通咽(B错)，借牙弓和牙龈分为口腔前庭和固有口腔(C对)，上下牙咬合时，口腔前庭与固有口腔借第三磨牙后方间隙相通(D错)，为唇、腭、颊之间的间隙(E错)。